女性，28岁。发热半月，弛张热，伴恶寒，关节痛，体检：皮肤瘀点，Osler结节，心脏有杂音，考虑为感染性心内膜炎，确诊的直接证据来自
A. 血液学检查
B. X线和心电图检查
C. 超声心动图检查
D. 免疫学检查
E. 组织学和细菌学检查

正确答案：E。组织学和细菌学检查

解析：感染性心内膜炎确诊的直接证据来自组织学和细菌学检查（E对），在近期未接受过抗生素治疗的患者血培养阳性率可高达95%以上。血液学检查（A错）、X线和心电图检查（B错）、超声心电图检查（C错）和免疫学检查（D错）为间接证据，对感染性心内膜炎的诊断有一定意义，但并不能作为确诊的直接证据。